肺动脉干起自
A. 左心房
B. 左心室
C. 右心房
D. 右心室
E. 无

正确答案：D。右心室

解析：起于右心室（D对）的为肺动脉干。起于左心室（B错）的为升主动脉。